关于子宫颈的解剖学，下列哪项不正确
A. 子宫颈分为阴道上部和阴道部
B. 子宫峡部下端是组织学内口
C. 宫颈管粘膜上皮在组织学内口处由柱状上皮变为鳞状上皮
D. 宫颈粘膜上皮有分泌粘液功能
E. 青春期宫体与宫颈之比为1：2

正确答案：C。宫颈管粘膜上皮在组织学内口处由柱状上皮变为鳞状上皮

解析：子宫颈以阴道为界，分为阴道上部和阴道部（A对）。子宫峡部上端因解剖上狭窄，称为解剖学内口，子宫峡部下端因子宫内膜转变为子宫颈黏膜，称为组织学内口（B对），但是宫颈管黏膜上皮未发生改变，都是单层柱状上皮（C错，为本题正确答案）。柱状上皮转变为鳞状上皮发生在宫颈管外口。宫颈黏膜上皮内腺体可分泌碱性黏液（P07）（D对）。子宫体与子宫颈的比例因年龄和卵巢功能而异，青春期前为1：2，育龄期为2：1（Ｅ对），绝经后为1：1（P06）。女性育龄期一般指15～49岁，而WHO规定青春期10～19岁，也就是说育龄期包含部分青春期，并不完全等于青春期，此题E选项并不严谨。